氯霉素或抗肿瘤药所致的骨髓抑制，属于
A. 副作用
B. 毒性反应
C. 首剂效应
D. 药物本身作用
E. 变态反应

正确答案：B。毒性反应

解析：本题考查毒性反应。氯霉素或抗肿瘤药所致的骨髓抑制，属于毒性反应（B对）。毒性反应是指在药物剂量过大或体内蓄积过多时发生的危害机体的反应。长期用药时由于药物在体内蓄积而逐渐发生的毒性称为慢性毒性，多损害肝、肾、骨髓、内分泌等功能。副作用（A错）是指在药物按正常用法用量使用时，出现的与治疗目的无关的不适反应。首剂效应（C错）是指一些患者在初服某种药物时，由于机体对药物作用尚未适应而引起不可耐受的强烈反应。例如哌唑嗪等按照常规剂量开始治疗常可致血压骤降。变态反应（E错）是指机体受药物刺激所发生异常的免疫反应，引起机体生理功能障碍或组织损伤。